血管紧张素Ⅰ转化酶抑制药
A. 氯沙坦
B. 卡托普利
C. 可乐定
D. 哌唑嗪
E. 氢氯噻嗪

正确答案：B。卡托普利